安息香的功效是
A. 开窍清热
B. 开窍化湿
C. 开窍息风
D. 开窍活血
E. 开窍祛痰

正确答案：D。开窍活血

解析：本题考查的是安息香的功效。安息香的功效是开窍活血（D对）。安息香：【功效】开窍辟秽，行气活血，止痛。冰片：【功效】开窍醒神，清热（A错）止痛。石菖蒲：【功效】开窍宁神，化湿（B错）和胃。牛黄：【功效】清热解毒，息风止痉，化痰开窍（C错）。远志：【功效】安神益智，祛痰开窍（E错），消散痈肿。